我国禁止销售和使用的有机磷农药是
A. 乐果
B. 氧化乐果
C. 马拉硫磷
D. 乙硫磷
E. 对硫磷

正确答案：E。对硫磷

解析：本题考查我国禁止销售和使用的有机磷农药。我国禁止销售和使用的有机磷农药是甲胺磷、对硫磷（E对ABCD错）、甲基对硫磷、久效磷、磷胺5种。